药用罂粟壳
A. 供医疗单位在医生指导下使用
B. 在省级新药特药商店零售
C. 在医药商店零售
D. 在医药商店凭盖有医疗单位公章的医生处方配方
E. 供县以上主管部门指定的医疗单位使用

正确答案：D。在医药商店凭盖有医疗单位公章的医生处方配方

解析：本题考查药用罂粟壳。药用罂粟壳由医药商店凭盖有医疗单位公章的医生处方配方（D对）。《条例》规定，麻醉药品目录中的罂粟壳只能用于中药饮片和中成药的生产以及医疗配方使用。